放线菌感染的病变部位可见
A. 异染颗粒
B. 质粒
C. 硫磺样颗粒
D. Dane颗粒
E. 包涵体

正确答案：C。硫磺样颗粒

解析：放线菌感染表现为慢性脓肿及形成瘘管，向外排出的黄色黏稠的脓液中，肉眼可见的黄色米粒大小颗粒，称作硫磺样颗粒，为放线菌病的指征。掌握“放线菌属”知识点。